高压蒸汽灭菌法通常在103.4kPa（1.05kg/cm²）的压力下维持时间为
A. 1～5分钟
B. 6～10分钟
C. 15～20分钟
D. 30～40分钟
E. 55～60分钟

正确答案：C。15～20分钟